女性50岁，烧伤3小时，体重60kg，双小腿及双足有水泡，创面湿润，疼痛明显。烧伤面积为
A. 0.2
B. 0.19
C. 0.13
D. 0.21
E. 0.3

正确答案：B。0.19

解析：根据烧伤面积双小腿占13%，女性双足占6%，此题总共烧伤面积为13%+6%=19%（0.19）（B对）。